对空腹血糖正常，但餐后血糖明显升高的糖尿病患者应选的药物是
A. 胰岛素
B. 磺脲类口服降糖药
C. 双胍类口服降糖药
D. α-葡萄糖苷酶抑制剂
E. 噻唑烷二酮类药物

正确答案：D。α-葡萄糖苷酶抑制剂

解析：本题考查降糖药。单纯餐后血糖升高，而空腹和餐前血糖不高，首选α-葡萄糖苷酶抑制剂（D对）。胰岛素（A错）用于治疗1型糖尿病、糖尿病合并感染以及酮症。磺脲类口服降糖药（B错）用于治疗2型非肥胖型糖尿病。二甲双胍（C错）可作为2型肥胖型糖尿病的首选。噻唑烷二酮类（E错）是餐后血糖升高为主，伴餐前血糖轻度升高的首选。